玉液汤的君药是
A. 山药、知母
B. 山药、黄芪
C. 知母、葛根
D. 五味子、天花粉
E. 鸡内金、天花粉

正确答案：B。山药、黄芪

解析：生山药补脾固肾以止小便频数，润肺生津而止口渴，以黄芪升阳益气，助脾气上升，复其散精达肺之职，二者共为君药（B对）。知母、天花粉为臣药，滋阴润肺止渴（ABDE错）。鸡内金为佐药助脾运化（E错）。葛根为佐药升脾中清阳，五味子敛阴生津为佐药。